属于严格管理的乙类传染病的数量是
A. 37种
B. 39种
C. 24种
D. 25种
E. 20种

正确答案：C。24种

解析：本题考查严格管理的乙类传染病的数量。目前我国的乙类传染病有26种，其中传染性非典型肺炎和肺炭疽按甲类传染病管理。所以属于严格管理的乙类传染病的数量是24种（C对ABDE错）。